罗替戈汀长效混悬型注射剂处方中含有上述主要辅料，其中，用于调节渗透压，降低注射剂刺激性的辅料是
A. 甘露醇
B. 磷酸二氢钠
C. 柠檬酸
D. 聚山梨酯20
E. PEG4000

正确答案：A。甘露醇

解析：本题考查处方分析。用于调节渗透压，降低注射剂刺激性的辅料是甘露醇（A对）。罗替高汀（罗替戈汀）长效混悬型注射剂处方中：罗替戈汀为主药，聚山梨酯20（D错）为表面稳定剂，用于保持悬浮液稳定性；PEG4000（E错）为助悬剂，用于增加分散介质的黏度，以降低微粒的沉降速度；磷酸二氢钠（B错）为pH调节剂；甘露醇为渗透压调节剂；柠檬酸（C错）为螯合剂，用于提高注射剂稳定性。罗替戈汀长效混悬型注射剂，用于治疗早期和进展期的帕金森综合征，通过肌内或皮下注射，罗替戈汀于体内形成药物库，从而缓慢释放，达到长效治疗效果，能够维持两周或更长时间，同时减少给药次数，提高了患者顺应性。通过控制药物平均粒径实现药物缓慢或平稳释放。